可治疗头痛眩晕癫狂的是
A. 解溪
B. 梁丘
C. 大横
D. 归来
E. 太白

正确答案：A。解溪

解析：该题主要考察各腧穴主治。解溪主冶下肢痿痹、踝关节病、足下垂等下肢、踝关节疾患；头痛，眩晕；癫狂；腹胀、便秘（A对）。梁丘主冶急性胃痛；膝肿痛、下肢不遂等下肢病证；乳痈、乳痛等乳疾（B错）。大横主治腹痛、腹泻、便秘等脾胃病证（C错）。归来主冶小腹痛，疝气；月经不调、带下、阴挺等妇科疾患（D错）。太白主治肠鸣、腹胀、腹泻、胃痛、便秘等脾胃病证；体重节痛（E错）。